下述哪个束路传导右下肢的精细触觉
A. 脊髓丘脑束
B. 右侧薄束
C. 右侧楔束
D. 右侧内侧丘系
E. 左侧脊髓丘系

正确答案：B。右侧薄束

解析：右下肢的精细触觉由躯干和四肢意识性本体感觉的精细触觉传导通路控制。该传导路由3级神经元组成：第1级神经元为脊神经节内假单极神经元，第2级神经元的胞体在薄、楔束核内，第3级神经元的胞体在丘脑后外侧核。由右侧薄束（B对）传导右下肢的精细触觉。